患者，女，64岁，患2型糖尿病、高脂血症，给予二甲双胍肠溶片0.5g，tid，po、瑞格列奈片1mg，tid，po、阿托伐他汀钙片20mg，tid，po等药物治疗。如果该患者需要给予低精蛋白锌胰岛素治疗。下列关于其用药教育说法，错误的是
A. 根据血糖水平调整低精蛋白锌胰岛素用量
B. 每3～5天调整1次
C. 每次调整1～4单位
D. 开启使用中的低精蛋白锌胰岛素必须冷藏保存
E. 冷冻后的低精蛋白锌胰岛素不可再使用

正确答案：D。开启使用中的低精蛋白锌胰岛素必须冷藏保存

解析：本题考查胰岛素制剂的使用。使用中的胰岛素笔芯不宜冷藏（D错，为本题正确答案）。药物治疗中应根据患者整体情况，制定个体化的治疗方案，根据睡前和3餐前血糖水平分别调整睡前和3餐前的胰岛素用量（A对），每3～5天调整一次（B对），每次调整1～4U（C对），未开启的胰岛素应冷藏保存，冷冻后的胰岛素不可再应用（E对）。